患者阻塞性睡眠呼吸暂停综合征（OSAS）其主要表现是
A. 打鼾、头痛、性格变化
B. 日间嗜睡、头痛、性格变化
C. 睡眠中呼吸暂停、打鼾
D. 打鼾、睡眠中呼吸暂停
E. 打鼾、嗜睡、睡眠中呼吸暂停、头痛、性格变化

正确答案：E。打鼾、嗜睡、睡眠中呼吸暂停、头痛、性格变化

解析：本题考查阻塞性睡眠呼吸暂停综合征的临床表现。阻塞性睡眠呼吸暂停综合症又名阻塞性睡眠呼吸暂停低通气综合症，是由于上气道解剖上的狭窄和呼吸控制功能失调而造成，可表现为打鼾、嗜睡、睡眠中呼吸暂停、头痛，由于睡眠时呼吸不通畅，供氧不足，长久以往会导致性格变化，如暴躁、精神错乱、敏感等性格变化（E对）。打鼾、头痛、性格变化（A错）；日间嗜睡、头痛、性格变化（B错）；睡眠中呼吸暂停、打鼾（C错）；打鼾、睡眠中呼吸暂停（D错）答案不全，均为错误答案。